治疗脾虚便溏尤应慎用的药物是
A. 石膏
B. 芦根
C. 知母
D. 天花粉
E. 淡竹叶

正确答案：C。知母

解析：该题考查药物的使用注意。知母，味苦、甘，性寒；入肺、胃、肾经；具有清热泻火，滋阴润燥的功效，有滑肠作用，脾虚便溏者不宜用（C对ABDE错）。